评价问卷测量结果与标准测量的接近程度的为
A. 复测信度
B. 复本信度
C. 准则效度
D. 内容效度
E. 折半信度

正确答案：C。准则效度